可导致慢性胎儿窘迫的是
A. 脐带绕颈
B. 胎盘功能减退
C. 羊水量增多
D. 胎盘早剥
E. 前置胎盘大出血

正确答案：B。胎盘功能减退

解析：胎儿窘迫指胎儿在子宫内因急性或慢性缺氧危及其健康和生命的综合症状，分急性胎儿窘迫和慢性胎儿窘迫，可导致急性胎儿窘的常见因素有：前置胎盘、胎盘早剥、脐带绕颈（ADE错）。导致慢性胎儿窘迫的因素为：母体血液含氧量不足、胎盘功能减退及胎儿严重疾病（B对）。